大部分口服药物在胃肠道中最主要的吸收部位是
A. 胃
B. 小肠
C. 盲肠
D. 结肠
E. 直肠

正确答案：B。小肠

解析：本题考查药物在胃肠道的吸收。小肠（B对）表面积很大，含有多种消化酶，为药物口服后的主要吸收部位。